属于金属离子螯合剂的是
A. 硬脂酸镁
B. 依地酸二钠
C. 微晶纤维素
D. 羧甲基纤维素钠
E. 碳酸氢钠

正确答案：B。依地酸二钠

解析：本题考查注射剂的附加剂。常用的金属离子络合剂有依地酸二钠（B对）、枸橼酸、酒石酸等，依地酸二钠最为常用，其浓度一般为0.005%～0.05%。